房间缺损常见部位为
A. 房间隔
B. 右心耳
C. 卵圆窝
D. 界嵴
E. 以上均不是

正确答案：C。卵圆窝

解析：卵圆窝（C对）是胚胎时期卵圆孔闭合后的遗迹，此处薄弱，为房间缺损的常见部位。